在一项病例对照研究中，计算出某因素比值比的95％可信区间为0.8～1.8，此因素可能为
A. 危险因素
B. 保护因素
C. 无关因素
D. 无法判断
E. 混淆因素

正确答案：C。无关因素